男，45岁。发作性呼吸困难5年，再发3天伴咳嗽咳白色泡沫痰，无咯血发热，有甲状腺功能亢进症病史1年。查体：BP135/90mmHg，呼气延长，双肺可闻及哮鸣音。发生呼吸困难最可能的机制是
A. 大支气管狭窄
B. 大支气管梗阻
C. 小支气管狭窄
D. 呼吸面积减少
E. 肺泡张力增高

正确答案：C。小支气管狭窄

解析：患者为中老年男性，发作性呼气性呼吸困难5年，呼气延长，双肺可闻及哮鸣音（为支气管哮喘的典型体征），可诊断为支气管哮喘，呼气性呼吸困难主要是细小支气管平滑肌痉挛所致（C对）。大支气管狭窄（A错）、大支气管梗阻（B错）主要导致吸气性呼吸困难。呼吸面积减少（D错）、肺泡张力增高（E错）主要见于COPD。